1945年，有一项研究调查了某手表厂表盘车间涂夜光的女工1000名和女话务员1000名，然后追踪观察并比较了她们从1945～1975年骨瘤发生率。结果30年间表盘车间女工发生了20例骨瘤，话务员中发生了4例骨瘤。表盘车间女工发生骨瘤的相对危险性为
A. 2
B. 5
C. 4
D. 16
E. 无法计算

正确答案：B。5

解析：本题考查相对危险度的计算。相对危险度比是暴露组的危险度（测量指标是累积发病率）与对照组的危险度之比。计算为相对危险度＝（20/1000）/（4/1000）＝5（B对ACDE错）。